气虚便秘的治法是
A. 清热润燥
B. 顺气导滞
C. 益气润肠
D. 养血润肠
E. 温阳通便

正确答案：C。益气润肠

解析：气虚便秘为脾肺气虚，传送无力所致，治法为益气润肠（C对），方用黄芪汤。清热润燥为热秘治法（A错）。顺气导滞为气秘治法（B错）。养血润肠为血虚秘治法（D错）。温阳通便为阳虚秘治法（E错）。